男性患者，45岁，半年前体检检查出肝硬化，夜晚突发消化道出血，下列哪种药物能够快速止血
A. 去甲肾上腺素
B. 对乙酰氨基酚
C. 阿司匹林
D. 新斯的明
E. 毛果芸香碱

正确答案：A。去甲肾上腺素

解析：去甲肾上腺素有强大的收缩皮肤黏膜血管的作用，此患者消化道出血可以使用去甲肾上腺素进行稀释后口服，可使消化道黏膜血管收缩，从而快速止血。掌握“去甲肾上腺素”知识点。